张某，男性，49岁。饮酒后突然出现右上腹部剧烈疼痛，无寒战、发热，Murphy征阳性，首先应考虑为
A. 急性胰腺炎
B. 急性胆管炎
C. 急性胆囊炎
D. 急性上消化道穿孔
E. 急性胃肠炎

正确答案：C。急性胆囊炎

解析：患者饮酒后发作右上腹痛，Murphy征阳性，首先考虑急性胆囊炎；因此患者疼痛部位和典型的Murphy征阳性体征，因此排除急性胰腺炎。掌握“急性胆囊炎”知识点。